以下有关舌的解剖的描述中，不恰当的是
A. 舌背上有“∧”形界沟
B. 舌盲孔为胚胎甲状舌管咽端的痕迹
C. 伞襞是舌系带两侧的黏膜皱襞
D. 伞襞与舌腹中线间的三角区内有舌神经及舌深血管穿行
E. 舌分为前2/3的舌根和后1/3的舌体

正确答案：E。舌分为前2/3的舌根和后1/3的舌体

解析：本题考查腭、舌、舌下区的局部解剖。舌的解剖表面标志：舌背上有“∧”形界沟（A对）将舌分为前2/3的舌体（舌的口部）和后1/3的舌根（舌的咽部）两部分（E错，为本题正确答案），在界沟的尖端有舌盲孔，为胚胎甲状舌管咽端的痕迹（B对）。舌腹与舌下区黏膜返折的中线处可见舌系带，舌系带两侧各有一条黏膜皱襞名伞襞（C对）。左、右伞襞与舌腹中线间的三角区内有舌神经及舌深血管穿行（D对）。